鼻炎片的功能是
A. 芳香化浊通鼻窍
B. 祛风宣肺，清热解毒
C. 祛风，清热解毒
D. 散风利胆，通窍
E. 疏散风热，清热利湿，宣通鼻窍

正确答案：B。祛风宣肺，清热解毒

解析：本题考查的是鼻炎片的功能。鼻炎片的功能是祛风宣肺，清热解毒（B对）。鼻炎片【功能】清热解毒，宣肺通窍，消肿止痛。霍胆丸【功能】芳香化浊，清热通窍（A错）。散风通窍滴丸【功能】清热祛风，散寒通窍（D错）。鼻窦炎口服液【功能】疏散风热，清热利湿，宣通鼻窍（E错）。